耐受性是
A. 机体连续多次用药后，其反应性降低，需加大剂量才能维持原有疗效的现象
B. 反复使用具有依赖性特征的药物，产生一种适应状态，中断用药后产生的一系列强烈的症状或损害
C. 病原微生物对抗菌药的敏感性降低甚至消失的现象
D. 连续用药后，可使机体对药物产生生理/心理的需求
E. 长期使用拮抗药造成受体数量或敏感性提高的现象

正确答案：A。机体连续多次用药后，其反应性降低，需加大剂量才能维持原有疗效的现象

解析：本题考查耐受性。耐受性（A对）机体连续多次用药后，其反应性降低，需加大剂量才能维持原有疗效的现象。反复使用具有依赖性特征的药物，产生一种适应状态，中断用药后产生的一系列强烈的症状或损害（B错）的现象为戒断综合征。病原微生物对抗菌药的敏感性降低甚至消失的现象（C错）为耐药性。连续用药后，可使机体对药物产生生理/心理的需求（D错）的现象为药物依赖性。长期使用拮抗药造成受体数量或敏感性提高的现象（E错）为受体的向上调节。